国务院卫生行政主管部门按照分类指导快速反应的要求，制定并报请国务院批准的是
A. 全国突发事件应急预案
B. 开展突发事件日常监测
C. 预防控制体系
D. 监测与预警系统
E. 制定行政区域应急预案

正确答案：A。全国突发事件应急预案

解析：《突发公共卫生事件应急条例》规定，国务院卫生行政部门按照分类指导、快速反应的要求，制定全国突发事件应急预案（A对），报请国务院批准。省、自治区、直辖市人民政府根据全国突发事件应急预案，结合本地实际情况，制定本行政区域的突发事件应急预案。